应告知患者服药后宜多饮水的药物有
A. 熊去氧胆酸
B. 阿仑膦酸钠
C. 苯溴马隆
D. 复方磺胺甲噁唑
E. 甘草合剂

正确答案：A、B、C、D。熊去氧胆酸；阿仑膦酸钠；苯溴马隆；复方磺胺甲噁唑

解析：本题考查服用后宜多饮水的药物。熊去氧胆酸（A对）服后可引起胆汁的过度分泌和腹泻，多饮水避免过度腹泻而脱水。阿仑膦酸钠（B对）可致水、电解质紊乱，故应补充液体。苯溴马隆（C对）为抗痛风药，为防止尿酸在排出过程中在泌尿道沉积形成结石，需多饮水。复方磺胺甲噁唑（D对）易出现结晶尿，需多饮水。甘草合剂（E错）服用时应限制饮水，避免将药物冲掉。